患者男性，18岁。右侧呼吸运动减弱，语颤消失，右下肺叩诊实音，实音区上方闻及支气管呼吸音。首先应考虑为
A. 支气管哮喘
B. 大叶性肺炎
C. 支气管扩张
D. 胸腔积液
E. 支气管肺癌

正确答案：D。胸腔积液

解析：本例患者为青少年男性，体格检查发现右侧呼吸动度减弱、语颤消失、右下肺叩诊实音，实音区上方闻及支气管呼吸音，诊断首先考虑为胸腔积液（D对）。支气管哮喘（A错）主要表现为发作性伴有哮鸣音的呼气性呼吸困难，查体可见双侧呼吸动度减弱、语颤减弱，叩诊呈过清音，呼吸音常减弱。大叶性肺炎（B错）主要表现为胸痛、咳嗽、咳痰，查体可见患侧呼吸动度减弱、语颤增强，叩诊浊音，可闻及支气管呼吸音。支气管扩张（C错）主要表现为慢性咳嗽、咯大量脓痰和反复咯血，查体可闻及湿啰音与干啰音。支气管肺癌（E错）主要表现为刺激性干咳，持续性痰中带血，查体可见局限性或单侧哮鸣音。